除了
A. 三叉神经脊束核
B. 迷走神经背核
C. 疑核
D. 孤束核
E. 下泌涎核

正确答案：E。下泌涎核

解析：下泌涎核（E对）属一般内脏运动核，此核发出副交感神经的节前纤维进入舌咽神经，管理腮腺的分泌，因而该核团与迷走神经无关。A、B、C、D选项均与迷走神经有联系：三叉神经脊束核（A错）属一般躯体感觉核，此核下部接受来自面神经、舌咽神经和迷走神经的一般躯体感觉纤维。迷走神经背核（B错）属一般内脏运动核，此核发出的副交感神经节前纤维参与组成迷走神经，支配颈部、胸部所有脏器和腹腔大部分脏器的平滑肌、心肌的活动和腺体的分泌。疑核（C错）属特殊内脏运动核，此核中部发出的纤维加入迷走神经，支配软腭和咽的骨骼肌，喉的环甲肌和食管上部的骨骼肌；下部发出的纤维构成副神经脑根，进入副神经，出颅后又离开副神经而加入迷走神经，最后经迷走神经的喉返神经，支配除环甲肌以外的喉肌。孤束核（D错）属内脏感觉核，此核上部（味觉核）接受经面神经、舌咽神经和迷走神经传入的味觉初级纤维；下部（心-呼吸核）主要接受经舌咽神经和迷走神经传入的一般内脏感觉初级纤维。